以下关于乳牙根尖周病的特点叙述不正确的是
A. 乳牙根尖周病早期症状不明显
B. 乳牙根尖周病以慢性炎症为主
C. 患牙叩诊时仅有叩痛没有松动
D. 瘘管出现后，急性炎症转为慢性炎症
E. 乳牙牙周组织疏松，脓液容易从龈沟排出

正确答案：C。患牙叩诊时仅有叩痛没有松动

解析：乳牙根尖周病的特点①乳牙根尖周病早期症状不明显，往往出现急性炎症时才就诊。②慢性炎症为主，临床上的急性根尖周炎多是慢性根尖周炎急性发作引起，可出现较剧烈的自发痛、咀嚼痛和咬合痛。③患牙松动并有叩痛。根尖部或根分歧处牙龈红肿，有的出现面部肿胀，局部淋巴结肿大，并伴有全身发热等症状。④集聚在根尖周的脓液可沿阻力小的部位排出，使牙龈出现瘘管，反复溢脓，反复肿胀。瘘管出现后，急性炎症转为慢性炎症。⑤乳牙牙周组织疏松，脓液容易从龈沟排出，加剧乳牙松动。若及时治疗，炎症很快消退。炎症消退后，牙周组织还能愈合并恢复正常。⑥X线片检查可见根尖部和根分歧部牙槽骨破坏的透射影像，是诊断慢性根尖周炎或慢性根尖周炎急性发作的重要指标。掌握“乳牙牙髓病及根尖周病诊断及治疗”知识点。